大蓟炒炭后的性味是
A. 苦、温
B. 苦、平
C. 苦、寒
D. 苦、涩、凉
E. 甘、苦、凉

正确答案：D。苦、涩、凉

解析：本题考查的是大蓟的炮制作用。大蓟炒炭后的性味是苦、涩、凉（D对）。大蓟【炮制作用】大蓟味甘、苦，性凉。归心、肝经。具有凉血止血，祛瘀消肿的功能。生大蓟以凉血消肿力胜，常用于热淋，痈肿疮毒及热邪偏盛的出血证。治心热吐血及衄血、崩中下血，均可用本品捣后绞取汁内服（《圣惠方》）。大蓟炭味涩、凉性减弱，收敛止血作用增强。用于吐血、呕血、咯血、嗽血等出血较急剧者。如十灰散（《十药》）。